下列呼吸性酸中毒合并代谢性酸中毒的特点中，哪项是不正确的？
A. pH明显降低
B. HCO₃⁻减少和PaCO₂增高，二者不能相互代偿
C. SB、AB、BB变化不大，AB<SB
D. 血K⁺升高
E. AG增大

正确答案：C。SB、AB、BB变化不大，AB<SB

解析：呼吸性酸中毒合并代谢性酸中毒由于都是酸中毒，所以PH明显降低（A对），肾和肺都处于失代偿状态，导致HCO₃⁻减少和PaCO ₂增高，二者不能相互代偿（B对），由于血浆HCO₃⁻减少，SB、AB及BB均降低，AB>SB（C错，为本题正确答案），代谢性酸中毒导致体内固定酸增多，AG增大（E对）。酸中毒时由于细胞外H⁺浓度升高，细胞内K⁺流向细胞外与H⁺交换，血浆K⁺浓度升高（D对）。